关于地高辛作用特点的说法，正确的是
A. 地高辛不经细胞色素P450酶代谢，以原形药物从肾脏排泄
B. 地高辛通过激动Na⁺，K⁺-ATP酶增强心肌收缩力
C. 地高辛口服生物利用度小于50%
D. 地高辛消除半衰期为12h
E. 地高辛静脉注射后作用持续时间为2～3h

正确答案：A。地高辛不经细胞色素P450酶代谢，以原形药物从肾脏排泄

解析：本题考查地高辛作用特点。地高辛不经细胞色素P450酶代谢，主要以原形药物从肾脏排泄（A对），肾衰竭者其半衰期可以延长3倍。地高辛为强心苷类药物，强心苷类主要是通过抑制Na⁺，K⁺-ATP酶（B错）发挥正性肌力作用。口服地高辛的起效时间为1～2h，消除半衰期为36h（D错），生物利用度约为80%（C错），静脉注射5～30min起效，持续时间6h（E错）。